老年女性，大便艰涩，排出无力，腰膝酸软，畏寒肢冷，舌淡，苔白，脉沉细，宜选方
A. 润肠丸
B. 济川煎
C. 黄芪汤
D. 补中益气汤
E. 五仁丸

正确答案：B。济川煎

解析：题中患者大便艰涩，诊断为便秘。阳气虚衰，寒自内生，肠道传送无力，故大便艰涩，排出无力；阳虚温煦无权，故畏寒肢冷，腰膝酸软；舌淡，苔白，脉沉细均为阳虚内寒之象，故诊断为阳虚秘，治疗应该用济川煎温阳通便（B对）。润肠丸养血润燥，为血虚秘的代表方（A错）。黄芪汤益气阴，去客热，主治痈溃后，气血两虚，内热口渴者（C错）。补中益气汤补中益气，升阳举陷，主治脾虚气陷证，气虚发热证（D错）。五仁丸润肠通便，主治津枯肠燥证（E错）。